奶瓶龋好发于
A. 上颌乳切牙的光滑面和第一乳磨牙的（牙合）面
B. 下颌乳切牙的光滑面和第一乳磨牙的（牙合）面
C. 上颌前牙的光滑面和磨牙的（牙合）面
D. 下颌前牙的光滑面和磨牙的（牙合）面
E. 全部乳牙

正确答案：A。上颌乳切牙的光滑面和第一乳磨牙的（牙合）面

解析：本题考查奶瓶龋的好发牙位。奶瓶龋是低龄儿童龋（CD错）的一种，主要由于不良的喂养习惯所致，主要发生于上颌乳前牙的唇面（A对E错），且较快发展成为广泛性龋。少见于下颌乳前牙（B错），可能与吸吮时下颌、下唇的运动、瓶塞所附牙面的位置、近舌下腺和下颌下腺导管开口等因素有关。此外，乳磨（牙合）面（A对）由于窝沟较多，也是奶瓶龋的好发部位。